医师在执业活动中享有的权利是
A. 遵守法律，法规，遵守技术操作规定
B. 关心、爱护、尊重患者
C. 努力钻研业务，提高业务水平
D. 依法获得酬劳
E. 宣传保健知识，对患者进行保健教育

正确答案：D。依法获得酬劳

解析：《执业医师法》规定，医师在执业活动中享有下列权利：①在注册的执业范围内，进行医学诊查、疾病调查、医学处置、出具相应的医学证明文件，选择合理的医疗、预防、保健方案；②按照国务院卫生行政部门规定的标准，获得与本人执业活动相当的医疗设备基本条件；③从事医学研究学术交流，参加医师协会和专业学术团体；④参加专业培训，接受继续医学教育，⑤在执业活动中，人格尊严、人身安全不受侵犯；⑥依法获得酬劳（D对），享受国家规定的福利待遇；⑦对所在机构的医疗、预防、保健工作和卫生行政部门的工作提出意见和建议，依法参与所在机构的民主管理。遵守法律、法规，遵守技术操作规范（A错）；关心、爱护、尊重患者（B错），保护患者的隐私；努力钻研业务，更新知识，提高业务水平（C错）；宣传保健知识，对患者进行保健教育（E错）都属于医师在执业活动中应当履行的义务。